一般食品冷冻保藏的温度设在
A. 0℃至40℃
B. -10℃以下
C. 0℃以下
D. -1℃以下
E. -18℃以下

正确答案：E。-18℃以下

解析：本题考查食品冷冻保藏的温度。一般食品冷冻保藏的温度设在-18℃以下（E对ABCD错）。